CTL通常是指
A. CD4⁺T细胞
B. CD8⁺T细胞
C. 巨噬细胞
D. 肥大细胞
E. B淋巴细胞

正确答案：B。CD8⁺T细胞